流行性出血热早期休克的主要原因
A. 病毒血症
B. 血浆外渗
C. 心肌损害
D. 微血管痉挛
E. 电解质紊乱

正确答案：E。电解质紊乱

解析：由于未及时补充水和电解质导致电解质紊乱（E对）有效循环血容量不足引发休克；病毒血症（A错）只造成高度乏力，全身酸痛等症状，多数患者有较突出的胃肠道症状，与休克无关；血浆外渗（B错）能进一步加重有效循环血容量不足，但影响不及电解质紊乱，故不是主要原因；流行性出血热没有造成心肌损害（C错），主要为肾脏损害；流行性出血热主要损伤毛细血管，出现颜面、颈部及上胸部 呈弥漫性潮红，没有微血管痉挛（D错）。